有一种含氮的药物，如用红外光谱判断它是否为腈类物质时，主要依据的谱带范围为
A. 3300～3000cm⁻¹
B. 3000～2700cm⁻¹
C. 2400～2100cm⁻¹
D. 1900～1650cm⁻¹
E. 1500～1300cm⁻¹

正确答案：C。2400～2100cm⁻¹

解析：本题考查红外吸收光谱。有一种含氮的药物，如用红外光谱判断它是否为腈类物质时，主要依据的谱带范围为2400～2100cm⁻¹（C对）。腈类物质含有C≡N键，其特征峰为2400～2100cm⁻¹。3300～3000cm⁻¹（A错）为≡C-H、=C-H、Ar-H的特征吸收谱带范围。3000～2700cm⁻¹（B错）为C-H（烷基）、-CHO的特征吸收谱带范围。1900～1650cm⁻¹（D错）为C=O（醛、酮、羧酸及其衍生物）的特征吸收谱带范围。1500～1300cm⁻¹（E错）为饱和聚烃、极性基团取代的聚烃的特征吸收的谱带范围。